患儿男，1岁，腹泻3天，每日大便7～8次，黄色稀便，无发热及呕吐，尿量稍减少。查体：体重9kg，哭有泪，皮肤弹性尚可，口唇黏膜略干燥。医师给予口服补液盐补充其累积损失量，正确的液量选择是
A. 250～450ml
B. 450～720ml
C. 750～920ml
D. 950～1020ml
E. 1050～1320ml

正确答案：B。450～720ml